前列腺增生症早期最常见的症状是
A. 尿闭
B. 尿失禁
C. 膀胱胀痛
D. 小便障碍
E. 夜尿次数增多

正确答案：E。夜尿次数增多

解析：前列腺增生症为老年男性的常见病之一。尿闭为前列腺增生症后期的表现（A错）。尿失禁为部分患者由于长期尿液不能排尽，致膀胱残余尿液增多而出现的假性尿失禁，非早期症状（B错）。膀胱胀痛不是前列腺增生早期的常见症状（C错）。小便障碍全程可见（D错）。前列腺增生临床以尿频、夜尿次数增多、排尿困难为主（E对）。